调剂时，复核的内容一般不包括
A. 药味是否相符
B. 剂数是否相符
C. 计价是否准确
D. 有无用药禁忌
E. 剂量是否准确

正确答案：C。计价是否准确

解析：本题考查的是中药饮片配复核内容。调剂时，复核的内容一般不包括计价是否准确（C错，为本题正确答案）。中药饮片调配复核内容：中药饮片调配后，必须经复核后方可发出。核对调配好的药品是否与处方所开药味及剂数相符（AB对），有无错味、漏味、多味和掺杂异物，每剂药的剂量误差应小于±5%（E对），必要时要复称。还需审查有无配伍禁忌（十八反、十九畏）、妊娠禁忌药物（D对），毒麻药有无超量。毒性中药、贵细药品的调配是否得当。对于需特殊煎煮或处理的药味如先煎、后下、包煎、烊化、另煎、冲服等是否单包并注明用法。审查药品质量，保证无伪劣饮片，审查有无虫蛀、发霉变质，有无生炙不分或以生代炙，整药、籽药应捣未捣，调配处方有无乱代乱用等现象。